呋塞米临床可用于
A. 急性肾功能衰竭
B. 严重水肿
C. 降血压
D. 调血脂
E. 加速某些毒物的排泄

正确答案：A、B、C、E。急性肾功能衰竭；严重水肿；降血压；加速某些毒物的排泄

解析：本题考查呋塞米的临床作用。呋塞米的临床作用：1.充血性心力衰竭、肝硬化、肾脏疾病（肾炎、肾病及各种原因所致的急、慢性肾衰竭），与其他药物合用治疗急性肺水肿和急性脑水肿等（B对）。2.高血压危象（C对）。3.高钾血症及高钙血症。稀释性低钠血症（尤其是当血钠浓度低于120mmol/L时）。4.预防急性肾衰竭（A对）。5.抗利尿激素分泌过多综合征（SIADH）。6.急性药物、毒物中毒（E对），如巴比妥类药物中毒等。呋塞米不能用于调血脂（D错）。